引起心肌能量生成障碍最常见的原因是
A. 急性心肌梗死
B. 自由基生成增多
C. 血容量过度增加
D. 心肌缺血缺氧
E. 交感神经强烈兴奋

正确答案：D。心肌缺血缺氧

解析：引起心肌能量生成障碍最常见的原因是冠心病导致的心肌缺血缺氧（D对）。血容量过度增加（C错）时，前负荷过重，心肌发生离心性肥大，过度肥大的心肌也可出现能量生成障碍。急性心肌梗死（A错）时，心肌细胞急性严重缺血缺氧，继而发生变性坏死，心肌收缩性降低。